男，22岁，受凉后出现咽痛，咳嗽，发热，1天后出现全程肉眼血尿2次，无尿频，尿急，尿痛。尿常规：蛋白（++），尿沉渣镜检：RBC满视野。血SCr74μmol/L。下列最有助于诊断的检查是
A. 肾穿刺活检
B. 尿培养
C. 膀胱镜
D. 泌尿系B超
E. 腹部CT

正确答案：A。肾穿刺活检

解析：患者青年男性（IgA肾病好发人群），受凉后出现咽痛，咳嗽，发热（呼吸道前驱症状），1天后出现全程肉眼血尿2次，无尿频，尿急，尿痛（排除炎症性疾病）。尿常规：蛋白（++）（正常不可见，提示蛋白尿），尿沉渣镜检：RBC满视野（血尿）。血SCr74μmol/L（男性正常值53～106μmol/L）。综合患者病史、症状及实验室检查，考虑诊断为IgA肾病，IgA肾病的确诊依赖于肾穿刺活检（A对）。尿培养（B错）多用于培养后鉴别泌尿道细菌性感染。膀胱镜（C错）用于观察输尿管及膀胱内情况。泌尿系统B超（D错）可以观察泌尿系统是否有结石积水等器质性病变。腹部CT（E错）目的是为了解腹腔脏器有无感染性疾病，如：炎症、结核、脓肿等；有无占位，如良、恶性肿瘤，转移性肿瘤等；有无畸形、结石、梗阻、穿孔、积液等